女性，20岁，病史10天，发热，贫血，出血，肝脾轻度肿大，颈部淋巴结肿大，伴关节痛，血红蛋白60g/L，白细胞35×10⁹/L，血小板80×10⁹/L，首先考虑
A. 风湿热
B. 病毒感染
C. 急性白血病
D. 淋巴病
E. SLE

正确答案：C。急性白血病

解析：青年女性患者，发热、贫血、出血（急性白血病的典型临床表现）、肝脾轻度肿大、颈部淋巴结肿大、伴关节痛（提示白细胞增殖浸润），实验室检查：血红蛋白60g/L（成年女性正常值为110～150g/L，血红蛋白减低），白细胞35×10⁹/L（正常值为4～10×10⁹/L，白细胞明显增高），血小板80×10⁹/L（正常值为100～300×10⁹/L，血小板减低），根据该患者的临床症状、体征及实验室检查，最可能的诊断为急性白血病（C对）。风湿热（A错）是一种因A组链球菌感染咽部引起的迟发性非化脓性后遗症该病具有多种临床表现，可能包括关节炎、心脏炎、舞蹈病、皮下结节及边缘性红斑，任何年龄均可发病，最常见人群是5-15岁的儿童和青少年，3岁以内的婴幼儿极少见。病毒感染（B错）白细胞降低而不增高。系统性红斑狼疮（SLE）（E错）是一种以致病性自身抗体和免疫复合物形成并介导器官、组织损伤的自身免疫病，临床上常存在多系统受累表现，血清中存在以抗核抗体为代表的多种自身抗体。